男，15岁。咽痛，发热1周，双下肢对称性紫癜伴腹痛及关节痛3天。实验室检查：血Hb125g/L，WBC10.5×10⁹/L，Plt110×10⁹/L，凝血时间正常，粪隐血（+）。最可能的诊断是
A. 免疫性血小板减少症
B. 血小板无力症
C. 急性白血病
D. 过敏性紫癜
E. 血友病

正确答案：D。过敏性紫癜

解析：青少年男性，咽痛、发热（感染史），双下肢对称性紫癜、腹痛、关节痛，粪隐血（+）。最可能的诊断是过敏性紫癜（D对）。免疫性血小板减少症（ITP）（A错）：血小板计数减少，常表现为反复的皮肤黏膜出血如瘀点、紫癜、瘀斑及外伤后止血不易等，鼻出血、牙龈出血、月经过多亦很常见。血小板无力症（B错）属于先天性血小板质量异常。急性白血病（C错）表现为贫血、出血、感染和浸润等征象。血友病（E错）属于先天性凝血异常，出血多为自发性或轻度外伤、小手术后（如拔牙、扁桃体切除）出血不止，常表现为软组织或深部肌肉内血肿。